表现为白细胞计数减少的疾病是
A. 急性化脓性感染
B. 再生障碍性贫血
C. 粒细胞白血病
D. 糖尿病酮症酸中毒
E. 急性出血和溶血

正确答案：B。再生障碍性贫血

解析：本题考查血常规检查。表现为白细胞计数减少的疾病有：再生障碍性贫血（B对）、白细胞减少性白血病、粒细胞缺乏症等。急性化脓性感染（A错）、粒细胞白血病（C错）、糖尿病酮症酸中毒（D错）、急性出血和溶血（E错）表现为白细胞计数增加。